津液的输布、排泄依赖于
A. 心、肺、肾、肝
B. 肺、脾、肾
C. 心、肺、脾、肝
D. 脾、胃、肺、肾
E. 肺、小肠、肾、三焦

正确答案：B。肺、脾、肾

解析：本题考查的是津液的代谢。津液的输布、排泄依赖于肺、脾、肾（B对）。津液来源于饮食水谷，通过胃对饮食物的“游溢精气”和小肠的“分清别浊”，再“上输于脾”而生成。津液的输布和排泄，主要是通过脾的转输、肺的宣降和肾的蒸腾气化，以三焦为通道而输布于全身的。津液的输布和排泄需要气和许多脏腑一系列生理功能的协调配合，但以肺、脾、肾三脏为主。